病因判定标准中哪些是必需的
A. 前因后果和终止效应
B. 前因后果和关联的合理性
C. 广义关联强度和关联的可重复性、关联的合理性
D. 广义关联强度和前因后果

正确答案：D。广义关联强度和前因后果

解析：本题考查病因判定的标准。病因判定标准中广义关联强度和前因后果（D对ABC错）是必需的。此外剂量-反应关系、合理性、一致性以及实验证据等都是所必需的。